代谢性碱中毒对机体的影响是
A. 中枢神经系统受抑制
B. 高钾血症
C. 血浆CO2浓度降低
D. 血管对儿茶酚胺的反应性持续降低
E. 血红蛋白氧离曲线左移

正确答案：E。血红蛋白氧离曲线左移

解析：发生代谢性碱中毒时呼吸抑制，通气量下降，血浆CO2继发性升高（C错），中枢神经系统由于γ-氨基丁酸转氨酶活性增强表现为兴奋（A错），血液pH升高可使血红蛋白与02 的亲和力增强血红蛋白氧离曲线左移（E对），细胞内H+逸出，而细胞外液k+进入细胞内，从而产生低钾血症（B错）。血管对儿茶酚胺的反应性持续降低（D错）是代谢性酸中毒对机体的影响。